对第二代抗精神病药物的描述，正确的是
A. 能够有效地控制精神分裂症的阴性症状
B. 除能拮抗中枢神经系统多巴胺受体外，还能拮抗中枢去甲肾上腺素受体
C. 在治疗精神病的阳性症状方面不如传统的抗精神病药物
D. 多数药物锥体外系副作用相对较多但其他副作用较少
E. 主要包括泰尔登氯氮平利培酮

正确答案：A。能够有效地控制精神分裂症的阴性症状

解析：第二代精神药物（非传统抗精神病药物）能够有效地控制精神分裂症的阴性症状（A对）。第二代精神药物主要药理作用为阻断5-HT（5-羟色胺）与中枢多巴胺D2受体（B错）。治疗剂量时，较少产生椎体外系副作用（D错）。泰尔登（氯普噻吨）为第一代抗精神病药物（E错），氯氮平、利培酮均是第二代精神药物（非传统抗精神病药物）。